心室肌细胞动作电位的锋电位由哪部分形成
A. 0期去极和4期自动去极
B. 1期复极和2期复极
C. 0期去极和1期复极
D. 2期复极和3期复极
E. 0期去极至3期复极

正确答案：C。0期去极和1期复极